以上腧穴中，治疗汗证首选的是
A. 内关
B. 复溜
C. 太溪
D. 阴谷
E. 太冲

正确答案：B。复溜

解析：该题主要考察各腧穴的主治，是记忆类题目。复溜主治水肿、汗证（无汗或多汗）等津液输布失调病证（B对）；腹胀、腹泻、肠鸣等胃肠病证；腰脊强痛，下肢痿痹。